男，56岁，近半年工作压力大，经常出现差错，刚做过的事就记不起来，性格变得古怪，喜怒无常，有时情绪低落。一次喝了50ml啤酒后，找不到家而露宿街头。最可能的诊断是
A. 酒精所致遗忘综合征
B. 躁狂发作
C. 阿尔茨海默病
D. 抑郁发作
E. 分离（转换）性障碍

正确答案：C。阿尔茨海默病

解析：男，56岁（处于阿尔茨海默病的发病年龄），近半年工作压力大，经常出先差错，刚做过的事就记不起来，性格变得古怪，喜怒无常，有时情绪低落。一次喝了50ml啤酒后，找不到家而露宿街头。该患者主要表现为阿尔茨海默病（C对）的轻度痴呆阶段，即主要表现为记忆障碍，还有情绪上的变化。慢性酒精中毒所致精神障碍会导致酒精遗忘综合征，患者无长期大量饮酒史，且饮50ml啤酒后不会导致酒精遗忘综合征（A错）。躁狂发作（B错）时以情绪高涨、思维奔逸和活动增多为特征。抑郁发作（D错）时的主要症状有心境低落、兴趣减退、快感缺失。分离（转换）性障碍（E错）多起病于青少年期，常常急性起病，与一定的心理社会因素有关，症状复杂多样。